男性，50岁。车祸后6小时入院，神志淡漠，四肢冰冷，血压9.33/6.67kPa（70/50mmHg），诊断为
A. 轻度低血容量性休克
B. 中度低血容量性休克
C. 重度低血容量性休克
D. 中度感染性休克
E. 重度感染性休克

正确答案：B。中度低血容量性休克

解析：患者车祸6小时后入院，现神志淡漠，四肢冰冷，血压为70/50mmHg，考虑因车祸失血导致低血容量性休克。低血容量性休克分为轻度、中度、重度。轻度表现为：神志清楚，口渴、四肢发凉、收缩压正常或稍升高；中度表现为：表情淡漠，很口渴、皮肤发冷、苍白，收缩压70mmHg～90mmHg；重度表现为：意识模糊，神志昏迷、极度口渴、四肢厥冷、显著苍白、肢端青紫，收缩压＜70mmHg。该患者临床表现及体征符合中度休克标准，故诊断为中度低血容量性休克（B对AC错）。感染性休克（DE错）多指各种感染所致脓毒症以及其诱发的组织灌注不足、细胞代谢紊乱和功能障碍的病理过程，在外科常见于急性腹膜炎、胆道感染及泌尿系感染等，该患者车祸6小时后入院，发生感染几率较小。